精神疾病是指在各种生物学、心理学以及社会环境因素影响下，造成下列哪种损害所致的
A. 大脑功能失调
B. 小脑功能失调
C. 锥体系失调
D. 锥体外系失调
E. 胼胝体功能失调

正确答案：A。大脑功能失调